根据《药品管理法》，未按照规定开展药品上市后研究或上市后评价的行为，经警告逾期不改正的，应承担的行政法律责任为
A. 责令改正，给予警告
B. 责令停业整顿
C. 处十万元以上五十万元以下的罚款
D. 责令暂停销售

正确答案：C。处十万元以上五十万元以下的罚款

解析：本题考查违反药品上市后管理规定的法律责任。根据《药品管理法》，未按照规定开展药品上市后研究或上市后评价的行为，经警告逾期不改正的，应承担的行政法律责任为处十万元以上五十万元以下的罚款（C对）。违反药品上市后管理规定的法律责任：（一）未制定上市后风险管理计划的法律责任：根据《药品管理法》第127条第一款第6项的规定，有未制定药品上市后风险管理计划行为的，责令限期改正，给予警告；逾期不改正的，处十万元以上五十万元以下的罚款。（二）未按照规定开展上市后研究或上市后评价的法律责任：根据《药品管理法》第127条第一款第7项的规定，有未按照规定开展药品上市后研究或者上市后评价行为的，责令限期改正，给予警告（A错）；逾期不改正的，处十万元以上五十万元以下的罚款。（三）药品生产、经营和使用单位违反药品不良反应报告和监测规定的法律责任：药品不良反应，是指合格药品在正常用法用量下出现的与用药目的无关的有害反应。药品不良反应报告和监测，是指药品不良反应的发现、报告、评价和控制的过程。根据《药品管理法》第134条的规定，药品上市许可持有人未按照规定开展药品不良反应监测或者报告疑似药品不良反应的，责令限期改正，给予警告；逾期不改正的，责令停产停业整顿，并处十万元以上一百万元以下的罚款。药品经营企业未按照规定报告疑似药品不良反应的，责令限期改正，给予警告；逾期不改正的，责令停产停业整顿，并处五万元以上五十万元以下的罚款。医疗机构未按照规定报告疑似药品不良反应的，责令限期改正，给予警告；逾期不改正的，处五万元以上五十万元以下的罚款。药品网络交易第三方平台未依法履行管理义务的法律责任：根据《药品管理法》第131条的规定，药品网络交易第三方平台提供者未履行资质审核、报告、停止提供网络交易平台服务等义务的，责令改正，没收违法所得，并处二十万元以上二百万元以下的罚款；情节严重的，责令停业整顿（B错），并处二百万元以上五百万元以下的罚款。